依照《中华人民共和国药品管理法》，国务院药品监督管理部门会同国务院卫生行政部门制定
A. 实施批准文号管理的中药材、中药饮片品种目录
B. 组织药典委员会，负责国家药品标准的制定和修订
C. 实行处方药与非处方药分类管理制度的具体办法
D. 实行药品不良反应报告制度的具体办法
E. 药物临床试验机构资格的认定办法

正确答案：D。实行药品不良反应报告制度的具体办法